能温肾补精的是
A. 续断
B. 紫河车
C. 菟丝子
D. 何首乌
E. 益智仁

正确答案：B。紫河车

解析：本题考查的是紫河车的功效。能温肾补精的是紫河车（B对）。紫河车：【功效】温肾补精，养血益气。续断（A错）：【功效】补肝肾，行血脉，续筋骨。菟丝子（C错）：【功效】补阳益阴，固精缩尿，明目止泻，安胎，生津。何首乌（D错）：【功效】补益精血，解毒，截疟，润肠通便。益智仁（E错）：【功效】暖肾固精缩尿，温脾止泻摄唾。